对长期慢性病人，易采取的医患关系模式是
A. 主动-被动型
B. 被动-主动型
C. 指导-合作型
D. 共同参与型
E. 合作-指导型

正确答案：D。共同参与型

解析：医患关系的类型有主动-被动型、指导-合作型、共同参与型。共同参与型（D对）是一种以生物心理社会医学模式为指导思想而建立的医患关系。这种医患关系的特点是“医生帮助病人自我恢复”，模式的原型是“成人-成人”。在医疗活动中，病人不仅是积极的合作者，而且能够积极主动地参与到自己疾病的治疗过程之中。这种模式的医患关系与前两种类型相比，更加重视尊重病人的自主权，给予病人充分的选择权。这种模式适用于慢性疾病且具有一定知识的病人。主动-被动型（A错）是在医疗服务过程中，医生处于主动的、主导的地位，而病人完全处于被动的、接受医疗的从属地位，适用于某些特殊病人，如意识严重障碍的病人、婴幼儿病人、危重或休克病人、智力严重低下病人及某些精神疾病病人。指导-合作型（C错）是医生告诉病人做什么和怎么做，患者也可以向医生提出自己对疾病治疗的意见和观点，适用于急性病人的医疗过程。被动-主动型（B错）、合作-指导型（E错）均不是医患关系模式。